男性，75岁，全身淋巴结无肿大，查体:脾肋缘下5cm，染色体t(9;22)(q34;q11)，最可能是什么疾病
A. 骨髓纤维化
B. 急性髓系白血病
C. 慢性髓系白血病
D. 慢性淋巴细胞白血病
E. 急性淋巴细胞白血病

正确答案：C。慢性髓系白血病

解析：慢性髓系白血病：病程发展缓慢，脾脏多肿大；细胞遗传学及分子生物学检查：95%以上的CML细胞中出现Ph染色体（小的22号染色体），显带分析为t(9;22)(q34;q11)（C对）。9号染色体长臂上C-ABL原癌基因易位至22号染色体长臂的断裂点簇集区(BCR)形成BCR-ABL融合基因。其编码的蛋白主要为P210,P210具有酪氨酸激酶活性Ph染色体可见于粒、红、单核、巨核及淋巴细胞中。